患者，男，40岁。患“类风湿性关节炎”2年，现症见关节肿胀，以四肢小关节为主，僵硬变形，屈伸不利，痛处固定，昼轻夜重，口干不欲饮，舌质紫暗，苔白腻，脉细涩，实验室检查：RF阳性。其证型是
A. 风寒湿阻证
B. 痰瘀互结证
C. 风湿热郁证
D. 肝肾阴虚证
E. 以上皆不是

正确答案：B。痰瘀互结证

解析：类风湿性关节炎中医辨证分型分别为风湿痹阻证、寒湿痹阻证、湿热痹阻证、痰瘀互结证、肝肾亏虚证。风寒湿邪外感而致痹，湿邪阻滞气机，脾胃运化失司，水湿内停，可聚而为痰。寒、痰、湿皆可阻滞气机，使血行不畅而瘀血内生，或外因跌扑损伤，而使血溢脉外而成瘀。痰瘀皆为有形实邪，留滞于关节、肌肉，阻滞血脉，局部失养，而见关节漫肿，僵硬变形，屈伸受限，痛有定处。入夜阳入于阴，血行缓慢，脉络瘀滞更为明显，故疼痛昼轻夜重。舌质紫暗，苔白腻，脉细涩为痰瘀互结之象（B对）；风寒湿阻证表现为症状：肢体关节游走性冷痛，肿胀重着，遇寒加重，得温痛减，关节拘急，屈伸不利，晨僵、畏寒。舌质淡，苔白或白腻，脉弦紧、弦缓或沉（A错）；风湿热郁证症状：关节红肿热痛，晨僵，发热，口渴，纳呆，大便黏滞不爽，小便黄，舌质红，苔黄或黄腻，脉濡数或滑数（C错）；肝肾阴虚证症状为骨节顽疼僵硬，肿大变形，活动受限，筋脉拘急，肌肉萎缩，形体消瘦，腰膝酸软无力，舌质淡红，苔薄白，脉沉细（D错）。